治疗巨幼红细胞性贫血的药物是
A. 华法林
B. 肝素
C. 链激酶
D. 维生素B₁₂
E. 双嘧达莫

正确答案：D。维生素B₁₂

解析：本题考查维生素B₁₂。维生素B₁₂（D对）与叶酸机制相似，可用于巨幼红细胞性贫血、神经炎、口炎性腹泻等一系列疾病。维生素K可用于华法林（A错）能竞争性抑制维生素K环氧化物还原酶，从而抑制血液凝固。肝素（B错）为抗凝血药。链激酶（C错）用于溶解血栓。双嘧达莫（E错）主要用于缺血性心脏病、血栓栓塞性疾病、心肌缺血的诊断实验。